属于上皮组织发生的肿瘤是
A. 淋巴管瘤
B. 血管瘤
C. 乳头状瘤
D. 平滑肌瘤
E. 脂肪瘤

正确答案：C。乳头状瘤

解析：乳头状瘤（C对）常见于鳞状上皮、尿路上皮等被覆的部位，属于上皮组织发生的良性肿瘤。淋巴管瘤（A错）、血管瘤（B错）、平滑肌瘤（D错）及脂肪瘤（E错）均属于间叶组织发生的肿瘤。